下列处理急性牙周脓肿方法不恰当的是
A. 脓肿切开
B. 行牙龈翻瓣术
C. 消炎止痛
D. 调（牙合）
E. 局部冲洗牙周袋

正确答案：B。行牙龈翻瓣术

解析：本题考查急性牙周脓肿的治疗方法。下列处理急性牙周脓肿方法不恰当的是行牙龈翻瓣术（B错，为本题正确答案）。急性期时不能进行翻瓣手术，待急性期后经过基础治疗后才能行手术治疗。在脓肿初期脓液尚未形成，可以清除大块牙石，冲洗牙周袋（E对），必要时给以全身抗生素或支持疗法；当脓液形成且局限、出现波动时可根据脓肿的部位及表面黏膜的薄厚，切开后从牙周袋内或牙龈表面引流（A对）。急性牙周脓肿疼痛明显，治疗时应首先止痛（C对）。牙周脓肿患牙有伸长感，不能和对颌接触，适当调（牙合）能减轻病人痛苦（D对）。